下列哪项不是学校突发事件
A. 传染病暴发疫情
B. 食品污染中毒
C. 饮水与环境污染
D. 集体药物不良反应
E. 某班1个学生患感冒

正确答案：E。某班1个学生患感冒